女，25岁，2年来常在遇到不高兴的事情时，生气哭闹，出现四肢强直和抽搐样表现，发作时能听清楚家人的呼唤，不语，流眼泪，无唇舌咬伤和大小便失禁，本次因再次出现类似发作就诊，入院查体，呼之不应，不时四肢抽搐样发作，瞳孔无散大，对光反射存在，可能的诊断是
A. 分离（转换）障碍
B. 恐惧性焦虑障碍
C. 原发性癫痫
D. 抑郁障碍
E. 创伤后应激障碍

正确答案：A。分离（转换）障碍

解析：患者青年女性，在遇到不高兴的事情时（心理因素来源诱因），生气哭闹，不语，四肢强直和抽搐样表现。无唇舌咬伤和大小便失禁，瞳孔无散大，对光反射存在（提示无器质性病变）。可能的诊断是分离（转换）障碍（A对）。恐惧性焦虑障碍（B错）应有恐惧、焦虑的表现。原发性癫痫（C错）可有舌咬伤、脑电图异常，发作时瞳孔散大、对光反射消失。抑郁障碍（D错）以情感低落为主要临床表现，患者常常伴有焦虑或激越，甚至出现幻觉、妄想等精神病性症状。创伤后应激障碍（E错）是由于受到异乎寻常的威胁性、灾难性心理创伤，导致延迟出现和长期持续的精神障碍。在重大创伤性事件发生后，患者有各种形式的反复发生的侵入性创伤性体验重现（闪回）（P173）。